弱有机酸在胃肠道容易吸收的部位是
A. 胃
B. 小肠
C. 十二指肠
D. 直肠
E. 结肠

正确答案：A。胃